血液窒息性气体
A. 一氧化碳
B. 二甲苯
C. 氰化物
D. 二氧化硫
E. 二氧化碳

正确答案：A。一氧化碳

解析：本题考查血液窒息性气体的概念。血液窒息性气体是指一类阻止血红蛋白与氧结合或妨碍Hb向组织释放氧，影响血液运输氧气的能力，造成组织供氧障碍而窒息的气体。如一氧化碳（A对BCDE错）、一氧化氮，以及苯胺、硝基苯等苯的氨基、硝基化合物蒸气等。